一小儿身高85cm，前囟已闭，头围48cm，乳牙20枚，已会跳并能用简单的语言表达自己的需要，对人事有喜乐之分。按公式计算此小儿的体重约是
A. 9Kg
B. 10Kg
C. 12Kg
D. 13Kg
E. 14Kg

正确答案：C。12Kg

解析：该小儿的年龄最大的可能是2岁的原因是：小儿身高85cm，前囟闭合，已会跳，有喜乐之分，都是2岁时的表现。所以2岁时的体重为2×2＋8=12kg（C对）。